男，56岁。乏力，食欲不振、恶心、消瘦1个月。乙型肝炎病史10年。查体：皮肤巩膜无黄染，腹软，剑突下压痛，肝肋下3cm，可触及质硬的结节，Murphy征阴性，移动性浊音阳性。该患者若手术治疗，其禁忌症是
A. 合并肝硬化
B. 有消化道出血史
C. 有明显腹水
D. 癌肿位于肝右叶
E. 癌肿直径约10cm

正确答案：C。有明显腹水

解析：中老年患者，肝炎病史，消化道症状，肝大有质硬结节，考虑肝癌。肝癌患者肝功能正常时，可以施行手术。患者移动性浊音阳性，有明显的腹水（C错，为本题正确答案），表明肝功能较差，禁止手术。原发性肝癌多因肝硬化引起，应尽早进行手术切除部分肝（A对）。有消化道出血史应尽早手术进行止血和部分肝切除（B错）。癌肿位于肝右叶（D对）或癌肿直径约10㎝（E对），达全肝组织的50％以上者，可作姑息性肝切除。